Hippocrates法治疗的是
A. 膝关节脱位
B. 髋关节脱位
C. 肘关节脱位
D. 肩关节脱位
E. 腕关节脱位

正确答案：D。肩关节脱位

解析：肩关节脱位（D对）一般手法复位为局部麻醉下用Hippocrates法复位（P632）。膝关节脱位（A错）多采用牵拉复位。髋关节脱位（B错）复位常用手法为Allis法（P655）。肘关节脱位（C错）常用复位手法有Parvin法、Meyn法、牵拉法、膝顶法、旋转法（第三版实用外科学P2041-2042）。